肥胖人群在饮食时应尽量避免的烹调方式是
A. 煮
B. 炖
C. 拌
D. 蒸
E. 油煎炸

正确答案：E。油煎炸